适用于烧伤面铜绿假单胞菌感染的药物是
A. 磺胺醋酰
B. 磺胺嘧啶银盐
C. 氯霉素
D. 林可霉素
E. 利福平

正确答案：B。磺胺嘧啶银盐